以下不属于细菌的基本结构的是
A. 荚膜
B. 核质
C. 细胞质
D. 细胞膜
E. 细胞壁

正确答案：A。荚膜

解析：细菌的结构包括基本结构和特殊结构。细胞壁、细胞膜、细胞质和核质为基本结构，是细菌所共有的结构。细菌的特殊结构包括荚膜、鞭毛、菌毛及芽胞，为某些细菌所缺乏，而某些细菌所特有的结构。掌握“细菌的大小、形态和基本结构”知识点。